患者，男，20岁。近2周自觉乏力，食欲不振，厌油，腹胀。检查：巩膜无黄染，肝肋缘下2cm，有压痛，丙氨酸转氨酶升高。应首先考虑的是
A. 急性肝炎
B. 慢性肝炎
C. 重型肝炎
D. 瘀胆型肝炎
E. 肝炎肝硬化

正确答案：A。急性肝炎

解析：患者有乏力、食欲不振、厌油的症状提示肝脏病变，体检发现肝大且有压痛，丙氨酸转氨酶升高，无消瘦症状，并且发病较急，故首先考虑急性肝炎（A对）。慢性肝炎病程较长（B错）。重型肝炎（C错）、瘀胆型肝炎（D错）、肝炎肝硬化（E错）黄疸均较重。